清除物品上的致病微生物的是
A. 手工清洗
B. 清洗机清洗
C. 超声波清洗
D. 消毒
E. 灭菌

正确答案：D。消毒

解析：消毒：指清除或杀灭物品上的致病微生物，使之达到无害化的处理。掌握“口腔器械的消毒与灭菌及医疗废物处理”知识点。